患者，女性，45岁。有心肌缺血病史，经治疗后几年来一直健康。近日突然出现心慌、气短，数分钟后自然缓解，每日发作数次，发作时常伴有心绞痛症状。经心电图检查认为阵发性室上性心动过速，此时最好选用
A. 普鲁卡因胺
B. 硝苯地平
C. 维拉帕米
D. 索他洛尔
E. 普罗帕酮

正确答案：C。维拉帕米